药物性牙龈增生的牙龈组织症状除外的是
A. 呈淡粉红色
B. 质地坚韧
C. 略有弹性
D. 较易出血
E. 多数患者无自觉症状

正确答案：D。较易出血

解析：药物性牙龈增生的牙龈组织一般呈淡粉红色，质地坚韧，略有弹性，一般不易出血。多数患者无自觉症状，无疼痛。掌握“药物性牙龈肥大”知识点。